医疗保健为居民提供医疗、保健和康复服务可达到的目的是
A. 缓解患者及其家庭因健康问题带来的心理压力
B. 为患者提供有关预后的咨询
C. 为患者及其家庭提供相关的支持和照料
D. 增进个体的功能
E. 以上都可以

正确答案：E。以上都可以

解析：医疗保健的功能：通过为居民提供医疗、保健和康复服务，达到如下的目的：①延长寿命；②增进个体的功能；③缓解患者及其家庭因健康问题带来的心理压力；④解释患者及其家庭有关的健康和医学问题；⑤为患者提供有关预后的咨询；⑥为患者及其家庭提供相关的支持和照料。掌握“卫生系统及功能”知识点。